面神经属于
A. 运动神经
B. 感觉神经
C. 混合性神经
D. 交感神经
E. 副交感神经

正确答案：C。混合性神经

解析：面神经是以运动神经为主的混合神经，主要支配面部表情肌和传导舌前2/3的味觉及支配舌下腺、下颌下腺和泪腺的分泌。掌握“面神经、舌咽神经、舌下神经的分支与分布”知识点。